下列在哪一地区是口腔癌最高发病区
A. 欧洲
B. 南美洲
C. 北美洲
D. 东南亚
E. 澳大利亚

正确答案：D。东南亚

解析：口腔癌的地区分布特点：口腔癌在全世界都有发现，不同地区发病率不同，以东南亚地区发病率最高，这是因为当地居民有咀嚼烟草和槟榔的习惯。据我国2005年的调查，口腔恶性肿瘤在35～44岁年龄人群的患病率是17/10万，在65～74岁年龄人群的患病率为30/10万，约占全身恶性肿瘤的8.2%。掌握“口腔癌的预防”知识点。